可用于静脉给药的胰岛素/胰岛素类似物是
A. 普通胰岛素注射液
B. 精蛋白锌胰岛素注射液
C. 预混胰岛素注射液
D. 甘精胰岛素注射液
E. 低精蛋白锌胰岛素注射液

正确答案：A。普通胰岛素注射液

解析：本题考查岛素及胰岛素类似物的分类。普通胰岛素注射液（A对）可在抢救糖尿病酮症酸中毒和高血糖高渗性昏迷等紧急情况下静脉注射。精蛋白锌胰岛素注射液（B错）属于长效胰岛素，是在低精蛋白锌的基础上加大鱼精蛋白的比例，使更接近人的体液pH，溶解度更低，释放更加缓慢，作用持续时间更长。预混胰岛素注射液（C错）是指含有两种胰岛素的混合物，可同时具有短效和长效胰岛素的作用。甘精胰岛素注射液（D错）属于长效胰岛素，具有长效、平稳的特点，无峰值血浆药物浓度，属一日用药一次的长效制剂。低精蛋白锌胰岛素注射液（E错）属于长效胰岛素。